患者慢性心力衰竭5年，现症见心悸，气短，肢倦乏力，动则加剧，神疲咳喘，面色苍白，舌淡，脉沉细其治法应选
A. 补益心肺
B. 益气养阴
C. 益气活血
D. 益气温阳
E. 温补心肾

正确答案：A。补益心肺

解析：患者慢性心力衰竭病史5年，现主症为心悸，气短，肢倦乏力，动则加剧，可结合症状诊断为心气虚，又出现神疲咳喘，面色苍白，舌淡，脉沉细，可判断为肺气虚，故为心肺两虚，其治法为补益心肺（A对）。